下列关于医药价格和招采信用评价制度的主要内容的说法，错误的是
A. 国家医疗保障局制定信用目录评价清单，将医药商业贿赂、涉税违法等行为纳入医药价格和招采信用评价范围
B. 省级集中采购机构根据医药企业信用评级，可采取书面提醒告诫、提示风险信息等处置措施
C. 医药企业失信行为超过一定时限或依法撤销的，不再计入信用评价范围
D. 医药企业招标采购失信情况评定分级包括一般、中等、严重三个等级，每年动态更新

正确答案：D。医药企业招标采购失信情况评定分级包括一般、中等、严重三个等级，每年动态更新

解析：本题考查医药价格和招采信用评价制度的主要内容。建立医药企业信用评级机制省（区、市）集中采购机构依据法院判决或行政处罚决定认定事实开展信用评级，根据失信行为的性质、情节、时效、影响等因素，将医药企业在本地招标采购市场的失信情况评定为一般、中等、严重、特别严重四个等级，每季度动态更新（D错，为本题正确答案）。国家医疗保障局制定信用评价目录清单，将医药商业贿赂、涉税违法、实施垄断行为、不正当价格行为、扰乱集中采购秩序、恶意违反合同约定等有悖诚实信用的行为纳入医药价格和招采信用评价范围（A对）。省（区、市）集中采购机构根据医药企业信用评级，分别采取书面提醒告诫、依托集中采购平台向采购方提示风险信息、限制或中止相关药品或医用耗材投标挂网、向社会公开披露失信信息等处置措施（B对）。失信行为超过一定时限或依法撤销的，不再计入信用评价范围（C对）。